低温保藏食品宜采用的办法是
A. 速冻速融
B. 速冻缓融
C. 缓冻缓融
D. 缓冻速融
E. 以上都不是

正确答案：B。速冻缓融